以下复合树脂粘接修复术的操作步骤中，不正确的是
A. 洞缘釉质壁制备成45°角的短斜面
B. 可用于前牙，也可用于后牙
C. Ⅴ类洞釉质壁面积比较大，可以不制洞形
D. 前牙切角缺损、牙体的严重缺损，应将牙体缺损区边缘外5～8mm的正常釉质磨除部分
E. 短斜面的制备可加宽釉质酸蚀刻带

正确答案：D。前牙切角缺损、牙体的严重缺损，应将牙体缺损区边缘外5～8mm的正常釉质磨除部分

解析：前牙切角缺损、牙体的严重缺损，应将牙体缺损区边缘外3～5mm的正常釉质磨除部分，深度为0.5mm，以便扩大酸蚀粘接面积，增加充填体与牙齿的固位，但应尽可能不损伤邻面接触点区。掌握“树脂粘结概念及釉质、牙本质粘结”知识点。